慢性复发性腮腺炎腮腺造影
A. 末梢导管呈点状、球状扩张，排空迟缓，主导管及腺内导管无明显异常
B. 主导管、叶间、小叶间导管部分狭窄、部分扩张，呈腊肠样改变
C. 末梢唾液腺导管扩张，排空功能减退
D. 圆形、卵圆形或梭形充盈缺损
E. 不宜做腮腺造影

正确答案：A。末梢导管呈点状、球状扩张，排空迟缓，主导管及腺内导管无明显异常

解析：腮腺造影显示末梢导管呈点状、球状扩张，排空迟缓，主导管及腺内导管无明显异常。临床表现为单侧腮腺肿胀者，作双侧腮腺造影，约占半数患者可见双侧腮腺末梢导管点状扩张，故应常规作双侧腮腺造影。掌握“慢性复发性腮腺炎”知识点。